通过阻断血管紧张素Ⅱ受体而治疗慢性心功能不全的药物是
A. 地高辛
B. 氨力农
C. 卡托普利
D. 美托洛尔
E. 氯沙坦

正确答案：E。氯沙坦

解析：本题考查氯沙坦。氯沙坦（E对）为血管紧张素Ⅱ受体拮抗剂（ARB），可以通过阻断血管紧张素Ⅱ受体，松弛血管平滑肌，临床可用于治疗慢性心功能不全、心力衰竭、高血压等。地高辛（A错）为强心苷类正性肌力药。氨力农（B错）为磷酸二酯酶Ⅲ抑制剂，属于非强心苷类正性肌力药。卡托普利（C错）为血管紧张素转换酶抑制剂，用于降低血压。美托洛尔（D错）为选择性β₁受体阻断剂，用于高血压、心绞痛。